生物利用度高而且可以通过调节给药速率达到临床用药所需血药浓度的给药方法是
A. 口服给药
B. 直肠灌注
C. 肌内注射
D. 静脉滴注
E. 皮下注射

正确答案：D。静脉滴注

解析：本题考查注射给药的给药部位和吸收途径。静脉滴注（D对）的给药方法可直接进入血液循环，无吸收过程，生物利用度可达到100%，并且可通过调节输液速度达到合理的血药浓度；口服给药（A错）经胃肠道吸收，具有首关效应；直肠灌注（B错）、肌内注射（C错）、皮下注射（E错）均有吸收过程。